番泻叶粉末有
A. 单细胞非腺毛
B. 气孔为平轴式
C. 晶纤维
D. 腺毛头部多为4—8个细胞
E. 叶肉组织细胞含簇晶

正确答案：A、B、C、E。单细胞非腺毛；气孔为平轴式；晶纤维；叶肉组织细胞含簇晶

解析：本题考查的是番泻叶的显微鉴别。番泻叶粉末有单细胞非腺毛（A对）、气孔为平轴式（B对）、晶纤维（C对）、叶肉组织细胞含簇晶（E对）。番泻叶【显微鉴别】粉末：淡绿色或黄绿色。①上下表皮细胞表面观呈多角形，垂周壁平直；上下表皮均有气孔，主为平轴式，副卫细胞大多为2个，也有3个的（狭叶番泻叶）。②非腺毛单细胞，长100～350μm，直径12～25μm，壁厚，有疣状突起，基部稍弯曲。③晶纤维多，草酸钙方晶直径12～15μm。④草酸钙簇晶存在于叶肉薄壁细胞中，直径9～20μm。蓼大青叶【显微鉴别】粉末：蓝绿色。①表皮细胞多角形，垂周壁平直或微波状弯曲。②气孔多为平轴式，少数不等式。③腺毛头部4～8个细胞（D错），柄部2个细胞。④非腺毛多列性，壁木化增厚，常见于叶片边缘及主脉处。⑤叶肉细胞内含多量蓝色至蓝黑色色素颗粒。⑥草酸钙簇晶多见，直径12～80μm。